与阿米卡星合用会影响其排泄导致急性肾损害的药物是
A. 维生素B₆
B. 铝碳酸镁
C. 伏立康唑
D. 阿司匹林
E. 利福平

正确答案：D。阿司匹林

解析：本题考查药物的相互作用。阿司匹林（D对）可影响药物排泄，延长阿米卡星作用时间，导致急性肾损害。铝碳酸镁（B错）含有Ca²⁺、Mg²⁺等，与四环素类同服可形成难溶性的配位化合物，不利于吸收，影响疗效。伏立康唑（C错）属于肝药酶抑制剂。利福平（E错）属于肝药酶诱导剂。维生素B₆（A错）在最新版考试指南中未明确要求。